下列选项中，除了RR，与PAR%高低有关的因素是
A. 病例组人群暴露率
B. 人群中暴露比例
C. 暴露组与非暴露组的疾病发病率
D. 暴露组的疾病死亡率
E. 人群的平均暴露水平

正确答案：B。人群中暴露比例

解析：本题考查人群归因危险度百分比的影响因素。人群归因危险度百分比的影响因素为：①RR；②人群中暴露比例（B对ACDE错）。